阳明潮热，可出现
A. 身热不扬
B. 高热不退
C. 午后低热
D. 日晡潮热
E. 发热重，恶寒轻

正确答案：D。日晡潮热

解析：日晡潮热（D对）见于阳明潮热，表现为日晡（下午3～5时，即申时）发热明显，且热势较高，兼见口渴饮冷、腹胀便秘等症。阳明经气旺于申时，因胃肠燥热内结，正邪斗争剧烈，故在此时热势加重，常见于阳明腑实证，故亦称阳明潮热。身热不扬（A错）见于湿温潮热，表现为午后热甚，兼见身热不扬（即肌肤初扪之不觉很热，但扪之稍久即感灼手）。高热不退（B错）见于壮热，指高热（体温在39℃以上）持续不退，不恶寒只恶热的症状常见于伤寒阳明经证或温病气分证。午后低热（C错）见于阴虚潮热，表现为午后和夜间有低热。发热重，恶寒轻（E对）指病人自觉发热较重，同时又有轻微怕冷的症状，是风热表证的特征，由外感风热之邪所致。